首选青霉素治疗的是
A. 流脑
B. 霍乱
C. 炭疽
D. 伤寒
E. 痢疾

正确答案：C。炭疽

解析：青霉素是治疗炭疽的首选药（C对）。流脑常选用青霉素，头孢菌素和氯霉素（A错）。霍乱常用环丙沙星、诺氟沙星、多西环素和复方磺胺甲恶唑片（B错）。伤寒常用多西环素（D错）。轻型痢疾可不使用抗菌药物，严重病例常用喹诺酮类、黄连素等（E错）。